磷酸可待因需检查的特殊杂质是
A. 麻黄碱
B. 罂粟碱
C. 莨菪碱
D. 吗啡
E. 奎宁

正确答案：D。吗啡

解析：本题考查特殊杂质的检查。磷酸可待因需检查的特殊杂质是吗啡（D对）。